位于舌根部粘膜的是
A. 舌扁桃体
B. 咽扁桃体
C. 咽鼓管扁桃体
D. 腭扁桃体
E. 咽淋巴环

正确答案：A。舌扁桃体

解析：舌扁桃体(A对)位于舌根背面粘膜表面，咽扁桃体(B错)位于鼻咽部，咽鼓管扁桃体(C错)位于鼻咽部，腭扁桃体(D错)位于口咽部，咽淋巴环(E错)由鼻咽和口咽的结构和舌扁桃体构成。